胫神经损伤可能出现
A. 足外翻力减弱
B. “钩状足”畸形
C. “马蹄形足”畸形
D. 足底感觉正常
E. 足背感觉麻木

正确答案：B。“钩状足”畸形

解析：腓总神经损伤导致足外翻力减弱（A错），足背感觉麻木（E错），呈“马蹄形足”畸形（C错）。胫神经损伤导致足不能拓屈，不能以足尖站立，内翻力减弱，同时出现足底皮肤感觉障碍(D错)，呈“钩状足”畸形（B对）。